成人末梢血白细胞计数正常值的参考范围是
A. （3.5～10.0）×10⁹/L
B. （4.0～10.0）×10⁹/L
C. （3.5～11.0）×10⁹/L
D. （4.0～11.0）×10⁹/L
E. （5.0～12.0）×10⁹/L

正确答案：B。（4.0～10.0）×10⁹/L

解析：本题考查的是血常规检查。成人末梢血白细胞计数正常值的参考范围是（4.0～10.0）×10⁹/L（B对）。白细胞计数（WBC）：外周血白细胞起源于骨髓的造血干细胞，白细胞包括粒细胞、淋巴细胞和单核细胞三大类，其中粒细胞又分为中性分叶核粒细胞、中性杆状核粒细胞、嗜酸性粒细胞和嗜碱性粒细胞。白细胞计数是测定血液中各种白细胞的总数。参考值：成人：（4～10）×10⁹/L；6个月至2岁：（11～12）×10⁹/L；新生儿：（15～20）×10⁹/L。